《医疗机构制剂配制质量管理规范（试行）》规定应具有大专以上药学或相关专业学历要求的是
A. 医院药事管理委员会负责人
B. 制剂室和药检室负责人
C. 药品采购人员
D. 医疗机构制剂配制操作及药检人员
E. 药剂科负责人

正确答案：B。制剂室和药检室负责人

解析：本题考查医疗机构配制制剂的质量管理。《医疗机构制剂配制质量管理规范（试行）》规定应具有大专以上药学或相关专业学历要求的是制剂室和药检室负责人（B对）。制剂室和药检室的负责人应具有大专以上药学或相关专业学历，具有相应管理的实践经验，有对工作中出现的问题作出正确判断和处理的能力。制剂室和药检室的负责人不得互相兼任。从事制剂配制操作及药检人员（D错），应经专业技术培训，具有基础理论知识和实际操作技能。凡有特殊要求的制剂配制操作和药检人员还应经相应的专业技术培训。